接触石棉者往往可查出石棉小体，作为它的特点或意义中，哪个是错误的
A. 长＜300um，粗＜1～5um
B. 形状如火柴、哑铃、分节状
C. HE染色呈棕黄或黄绿色
D. 在咯痰或肺组织中可查出
E. 如查出较多时可作为石棉肺诊断的依据

正确答案：E。如查出较多时可作为石棉肺诊断的依据

解析：本题考查石棉小体的特征。石棉小体是石棉纤维被巨噬细胞吞噬后，由一层含铁蛋白颗粒和酸性黏多糖包裹沉积于石棉纤维之上所形成。石棉小体长10～300㎛，粗1～5㎛（A对），金黄色，典型者呈哑铃状（B对）、鼓杻状、分节或念珠样结构。石棉小体HE染色呈棕黄或黄绿色（C对），可在咯痰或肺组织中可查出（D对）。石棉小体不是石棉肺的诊断依据（E错，为本题正确答案）。不规则形小阴影是石棉肺X线表现的特征，是石棉肺诊断分期的主要依据。